较常见外阴发育异常及畸形
A. 阴蒂肥大、大阴唇融合、阴唇粘连、处女膜闭锁、先天性前庭尿瘘与粪瘘、两性畸形
B. 有先天性无阴道、阴道横隔、阴道纵隔、阴道斜隔、阴道闭锁和狭窄等。治疗常延至青春期后做手术整形
C. 双子宫、纵隔子宫、单角子宫、双角子宫等
D. 雄激素不敏感综合征
E. 特纳综合征

正确答案：A。阴蒂肥大、大阴唇融合、阴唇粘连、处女膜闭锁、先天性前庭尿瘘与粪瘘、两性畸形

解析：本题考查较常见外阴发育异常及畸形。较常见的外阴发育异常及畸形的有阴蒂肥大、大阴唇融合、阴唇粘连、处女膜闭锁、先天性前庭尿瘘与粪瘘、两性畸形（A对BCDE错），女性外阴发育异常及畸形的表现较多，如果没有影响日常生活及生育，一般不需要进行特殊处理，如果病情较严重，可能需遵医嘱进行手术治疗。